引导性组织再生术手术成功的要素包括
A. 选择严格的适应症
B. 菌斑控制良好
C. 生物膜的良好固定和维持
D. 精确的手术操作
E. 以上都是

正确答案：E。以上都是

解析：本题考查引导性组织再生术手术成功的要素。引导性组织再生术（GTR）是在牙周手术中利用膜性材料作为屏障，阻挡牙龈上皮在愈合过程中沿根面生长，阻挡牙龈结缔组织与根面的接触，并提供一定的空间，引导具有形成新附着能力的牙周膜细胞优先占领根面，从而在原已暴露于牙周袋内根面上形成新的牙骨质，并有牙周膜纤维埋入，形成牙周组织的再生。①三壁骨袋；②Ⅱ度根分叉病变；③局限性牙龈退缩，仅涉及唇面的牙龈退缩，邻面无牙槽骨吸收且牙龈乳头完整，因此GTR有严格的适应证（A对）。菌斑控制良好（B对）、生物膜的良好固定和维持（C对）、精确的手术操作（D对）都影响新附着的形成（ABCD均对，故E为本题的正确答案）。